28岁女性，产后8个月，哺乳。厌食1周。妇科检查子宫软，如妊娠40天大小，人工流产术中，探针探宫腔深度14cm，患者无明显腹痛，无阴道流血。应该考虑
A. 子宫肌瘤
B. 子宫肥大
C. 子宫后位
D. 子宫畸形
E. 子宫穿孔

正确答案：E。子宫穿孔

解析：患者人工流产术中，探针探宫腔深度14cm（子宫长7～8cm），且无明显腹痛，无阴道流血，考虑子宫穿孔（E对）。子宫肌瘤（A错）、子宫肥大（B错）、子宫后位（C错）、子宫畸形（D错）均不是人工流产术的并发症。